男婴，8个月。腹泻3天，大便10余次/日，蛋花汤样伴少量黏液，呕吐，4～5次/日。嗜睡，口干，尿量少。体检：精神萎靡，皮肤干燥，弹性较差，眼窝及前囟明显凹陷，哭时泪少。血钠132mmol/L，血钾4mmol/L。该患儿第一天选择的液体种类是
A. 1：4含钠液
B. 2：3：1含钠液
C. ORS含钠液
D. 1.4%碳酸氢钠
E. 2：6：1含钠液

正确答案：B。2：3：1含钠液

解析：患儿嗜睡，精神萎靡，皮肤干燥弹性差，眼窝及前囟明显凹陷，哭时泪少，尿少，应考虑中度脱水。重度脱水表现（外周循环衰竭，昏睡，哭时无泪，无尿，皮肤花纹，四肢厥冷） 哭时少泪，少尿，嗜睡为中度脱水表现。患儿血钠132mmol/L，应诊断为等渗性脱水。等渗性脱水补1/2张含钠液。2：3：1含钠液为1/2张（B对）。1：4含钠液为1/5张（A错），ORS（口服补液盐）含钠液为2/3张（C错），1.4%碳酸氢钠为等张（D错），2：6：1含钠液的张力为（2＋1）/（2＋6＋1）=1/3张（E错）。